下合穴中可治疗肠痈、痢疾的是
A. 足三里
B. 上巨虚
C. 下巨虚
D. 委中
E. 阳陵泉

正确答案：B。上巨虚

解析：上巨虚为大肠下合穴，【主治】1、肠鸣、腹痛、腹泻、便秘、肠痈、痢疾等胃肠病证；2、下肢痿痹。因此既可以治疗痢疾，又可以治疗肠痈（B对）。足三里（A错）主治胃痛、呕吐、噎嗝、腹胀、腹泻、痢疾、便秘等胃肠病症；下肢痿痹；癫狂等神志病；乳痈、肠痈等外科疾患；虚劳诸证，为保健要穴。下巨虚（C错）主治腹泻、痢疾、小腹痛等胃肠病症；下肢痿痹；乳痈。委中（D错）主治腰背痛、下肢痿痹等腰及下肢病症；腹痛、急性吐泻等急症；瘾疹、丹毒；小便不利、遗尿。阳陵泉（E错）主治黄疸、胁痛、口苦、呕吐、吞酸等肝胆犯胃病症；膝肿痛、下肢痿痹及麻木等下肢、膝关节疾患；小儿惊风。